支配臀大肌是
A. 臀上神经
B. 闭孔神经
C. 股神经
D. 坐骨神经
E. 臀下神经

正确答案：E。臀下神经

解析：臀上神经（A错）支配臀中肌和臀小肌。闭孔神经（B错）肌支主要支配闭孔外肌、长收肌、短收肌、大收肌和股薄肌，偶见发出分支至耻骨肌。股神经（C错）的肌支主要分布于髂肌、耻骨肌、股四头肌和缝匠肌。坐骨神经（D错）发出肌支支配股二头肌、半腱肌和半膜肌，同时也有分支至髋关节。臀下神经（E对）行于臀大肌深面，发出分支支配该肌。